哪种乳牙不应该拔除
A. 牙冠破坏严重，已无法修复的乳牙
B. 根尖周炎症已涉及继承恒牙牙胚
C. 乳牙有牙髓炎症可治疗，但离替换时间很近
D. 受继承恒牙萌出力的推压，使根尖露出龈外，常致局部黏膜创伤性溃疡
E. 有病灶感染迹象但能彻底治愈

正确答案：E。有病灶感染迹象但能彻底治愈

解析：本题考查乳牙拔除的适应证。有病灶感染迹象但能彻底治愈（E错，为本题的正确答案）无需拔除，应积极治疗，因为儿童时期乳牙及年轻恒牙对建立正常的恒牙（牙合）起着重要作用。儿童时期的拔牙指征与成人不同，应严格把握适应证。牙冠破坏严重，已无法修复的乳牙（A对）、根尖周炎症已涉及继承恒牙牙胚（B对）、乳牙有牙髓炎症可治疗，但离替换时间很近（C对）、受继承恒牙萌出力的推压，使根尖露出龈外，常致局部黏膜创伤性溃疡（D对）均为乳牙拔除的适应证。